毒物引起受试对象中的个别成员出现死亡的剂量
A. 绝对致死剂量（LD₁₀₀）
B. 最小致死剂量（LD₀₁）
C. 最大耐受剂量（LD₀）
D. 半数致死剂量（LD₅₀）

正确答案：B。最小致死剂量（LD₀₁）

解析：本题考查最小致死剂量（LD₀₁）。最小致死剂量（LD₀₁）（B对ACD错）指毒物引起受试对象中的个别成员出现死亡的剂量。